男，69岁，全口仅余左下7，其余为活动义齿。诉二周前不慎咬硬物，牙冠崩掉一小块，因疼痛不明显未给予重视，近来出现左侧舌根疼，口腔检查见左侧舌根有一溃疡，较恰当的处理是
A. 拔除左下7
B. 切除舌左缘的溃疡
C. 放疗
D. 调磨左下7锐利边缘，继观、随诊
E. 强的松加利多卡因于溃疡基底浸润注射10次

正确答案：D。调磨左下7锐利边缘，继观、随诊

解析：本题考查创伤性溃疡的疾病管理。患者全口仅余留左下7，左下7牙冠缺损后刺激舌体组织，继而在对应的左侧舌根部出现溃疡，根据患者的临床表现和口腔检查可知患者左侧舌根部为创伤性溃疡，对于创伤性溃疡的治疗去除刺激因素是首要措施，即调磨左下7锐利边缘，继观、随诊（D对）。去除刺激因素后溃疡往往很快明显好转或愈合。切除左舌缘的溃疡（A错）会对舌体组织造成损伤，且牙冠的锐利边缘未磨除，刺激因素持续存在，溃疡久而不愈。放疗（C错）是利用放射线治疗肿瘤的一种局部治疗方法，而创伤性溃疡不属于癌症，故不宜用放疗。全口仅余留左下7，且缺失牙已做活动义齿修复，若直接拔除左下7（A错）会影响活动义齿的固位与稳定。强的松加利多卡因于溃疡基底部浸润注射10次（E错）起消炎镇痛的作用，但仅能缓解患者疼痛，治标不治本，应该从源头上采取措施治疗创伤性溃疡。